寒凉性所示的功效有
A. 散风
B. 清热
C. 泻火
D. 凉血
E. 解热毒

正确答案：B、C、D、E。清热；泻火；凉血；解热毒

解析：本题考查清热药的功效。寒凉性所示的功效有清热（B对）、泻火（C对）、凉血（D对）、解热毒（E对）。清热药：凡药性寒凉，以清解里热为主要功效的药物，称为清热药。本类药药性大多寒凉，少数平而偏凉，味多苦，或甘，或辛，或咸。主能清热、泻火、凉血、解热毒、退虚热，兼能燥湿、利湿、滋阴、发表等。本类药主要适用于表邪已解、内无积滞的里热证，如外感热病高热、阴伤内热、湿热泻痢、温毒发斑、痈肿疮毒、阴虚潮热等。解表药：按其性能功效及临床应用，常将本类药物分为辛温解表药与辛凉解表药两类。其中，辛温解表药又称发散风寒药，性味多辛温，主能发散风寒（A错），发汗力强，主治外感风寒表证，兼治风寒湿痹、咳喘、水肿兼表等。辛凉解表药又称发散风热药，性味多辛凉，主能疏散风热，发汗力虽较缓和，但长于透解表热，主治外感风热表证，兼治风热咳嗽、麻疹不透、目赤多泪等。